治疗牙本质过敏症的机制是
A. 钝化周边牙髓神经
B. 使成牙本质细胞突起钙化
C. 使成牙本质细胞变性
D. 使牙本质小管直径变小或封闭
E. 加强釉质牙本质界的屏障作用

正确答案：D。使牙本质小管直径变小或封闭

解析：本题考查牙本质敏感症的治疗机制。治疗牙本质过敏症的机制是使牙本质小管直径变小或封闭（D对）。流体动力学说认为牙本质小管内的液体流动起重要作用。即作用于牙本质表面的刺激会引起牙本质小管内的液体发生多向流动，这种流动传到牙髓，会引起牙髓神经纤维的兴奋而产生痛觉。因此，治疗牙本质过敏症的机制是使牙本质小管直径变小或封闭，从而减少液压传导。